患儿，1岁。发热3天，流涕咳嗽，咽部及眼结膜充血，在下眼睑边缘见Stimson线，口腔黏膜充血，既往未接种麻疹疫苗。该患者诊断麻疹，该病疫苗接种年龄
A. 1个月
B. 3个月
C. 4个月
D. 6个月
E. 8个月

正确答案：E。8个月

解析：麻疹疫苗应在小儿生后8个月（E对）时接种，并在6岁时进行复种。小儿计划免疫数据比较多，且比较繁杂，对于初次计划免疫我们可以总结成顺口溜来记忆：出生卡介一双肝，二三四月脊髓好，三到五月百白破，六月乙肝八麻疹。及出生时接种卡介苗和乙肝疫苗，1个月（A错）时再次接种乙肝疫苗；2～4个月（BC错）接种脊髓灰质炎三价混合疫苗，每月一次，共三次。3～5个月（BC错）接种百白破混合制剂，每月一次，共三次。6个月（D错）时第三次接种乙肝疫苗，8个月（E对）接种麻疹疫苗。